关于大环内酯类抗菌药物与其它药物相互作用的说法，正确的有
A. 红霉素可抑制肝药酶活性，与环孢素合用可增加环孢素的血药浓度
B. 克拉霉素为肝药酶抑制剂，与华法林合用可增强华法林的抗凝活性
C. 阿奇霉素与氟喹诺酮类药物合用，可增加Q-T间期延长的风险
D. 琥乙红霉素与辛伐他汀合用，可增加肝毒性
E. 大环内酯类抗菌药物与林可霉素合用可产生协同作用

正确答案：A、B、C、D。红霉素可抑制肝药酶活性，与环孢素合用可增加环孢素的血药浓度；克拉霉素为肝药酶抑制剂，与华法林合用可增强华法林的抗凝活性；阿奇霉素与氟喹诺酮类药物合用，可增加Q-T间期延长的风险；琥乙红霉素与辛伐他汀合用，可增加肝毒性

解析：本题考查大环内酯类抗菌药物与其它药物的相互作用。红霉素可抑制肝药酶活性，与环孢素合用可增加环孢素的血药浓度（A对）。克拉霉素为肝药酶抑制剂，与华法林合用可增强华法林的抗凝活性（B对）。阿奇霉素与氟喹诺酮类药物合用，可增加Q-T间期延长的风险（C对）。琥乙红霉素与辛伐他汀合用，可增加肝毒性（D对）。大环内酯类抗菌药物与氯霉素或林可霉素合用，因竞争药物的结合位点，产生拮抗作用（E错）。